脏腑关系中被称为“燥湿相济”的是
A. 肺与大肠
B. 肾与膀胱
C. 心与肾
D. 肺与肝
E. 脾与胃

正确答案：E。脾与胃

解析：脾为阴脏，主运化水饮，喜燥而恶湿；胃为阳腑，主通降下行，喜润而恶燥；脾易生湿，得胃阳以制之，使脾不至于湿；胃易生燥，得脾阴以制之，使胃不至于燥。脾与胃阴阳燥湿相济是保证两者纳运、升降协调的必要条件。（E对）。肺与大肠（A错）通过经脉的相互属络构成了表里关系，肺气清肃下降，能促进大肠的传导，有利于糟粕的排泄。大肠传导正常，糟粕下行，亦有利于肺气的肃降。肾与膀胱（B错）通过经脉的相互属络构成了表里关系。肾为主水之脏，开窍于二阴；膀胱为津液之府。肾与膀胱相互协作，共同完成尿液的生成、贮存与排泄。心与肾（C错）的关系主要表现为“心肾相交”，包括了水火既济、精神互用、君相安位等。肺与肝（D错）的关系，主要体现在人体气机升降的调节方面。